女，28岁。咳嗽、流涕2周，心悸2天，无发热及胸痛。既往体健。查体：BP100/60mmHg。心界不大，心率108次/分，可闻及早搏4次/分，心尖部可闻及2/6级收缩期杂音，柔和，未闻及心包摩擦音。实验室检查：血肌钙蛋白I升高。心电图示房性期前收缩。该患者最可能的诊断是
A. 病毒性心肌炎
B. 扩张型心肌病
C. 感染性心内膜炎
D. 风湿性心脏瓣膜病
E. 急性心包炎

正确答案：A。病毒性心肌炎

解析：患者青年女性，咳嗽、流涕2周（提示病毒感染史），心悸2天，心电图示：房性期前收缩，血清肌钙蛋白I升高，是病毒性心肌炎的常见症状和体征，因此该患者最可能的诊断是病毒性心肌炎（A对）。扩张型心肌病（P262）（B错）起病隐匿，临床主要表现为活动时呼吸困难和活动耐量下降，常可见心界扩大。感染性心内膜炎（P309）（C错）多有发热、心脏瓣膜可变杂音等体征，不会出现血清肌钙蛋白升高。风湿性心脏瓣膜病（P285）（D错）患者多有风湿热病史，且多在年幼时发病，并伴有相应瓣膜区的改变，通常为单个或多个瓣膜及附属结构的功能或结构异常，导致瓣膜狭窄和（或）关闭不全，导致血流动力学改变从而出现心脏增大、心力衰竭等临床表现。急性心包炎（P302）（E错）常表现为胸骨后、心前区疼痛，呼吸困难，水肿等症状，常可闻及心包摩擦音。